应当设立或指定负责药品不良反应报告和监测的机构并配备专（兼）职人员的是
A. 药品生产企业
B. 药品经营企业
C. 临床试验机构伦理委员会
D. 药物安全性评价中心

正确答案：B。药品经营企业

解析：本题考查《药品不良反应报告和监测管理办法》。应当设立或指定负责药品不良反应报告和监测的机构并配备专（兼）职人员的是药品经营企业（B对）。《药品不良反应报告和监测管理办法》第二章法规第十三条：药品生产、经营企业和医疗机构应当建立药品不良反应报告和监测管理制度。药品生产企业（A错）应当设立专门机构并配备专职人员，药品经营企业和医疗机构应当设立或者指定机构并配备专（兼）职人员，承担本单位的药品不良反应报告和监测工作。